患者，男，48岁。诊断为急性心肌梗死，经治疗好转，心电图ST段持续抬高。此时应考虑的并发症是
A. 室间隔穿孔
B. 乳头肌功能失调或断裂
C. 左室扩大
D. 室壁瘤形成
E. 合并亚急性细菌性心内膜炎

正确答案：D。室壁瘤形成

解析：患者患有急性心肌梗死，经治疗后心电图ST段持续抬高，说明发生了并发症，为室壁瘤（D对）。室间隔穿孔多发生于前间壁，主要由心衰及心源性休克导致的血压下降，四肢湿冷，循环不稳定等（A错）。二尖瓣乳头肌收缩功能障碍可产生二尖瓣脱垂并关闭不全，引起心力衰竭。乳头肌腱索整体断裂少见，多发生在二尖瓣后乳头肌，心力囊竭明显，可迅速发生肺水肿而迅速死亡（B错）。左室扩大主要是由于增加心脏后负荷或心肌疾病导致（C错）。心肌梗死后综合征发生率约10%，于心肌梗死后数周至数月出现，可反复发生，表现为心包炎、胸膜炎或肺炎（E错），有发热、胸痛等症状，可能为机体对坏死物质的过敏反应。